（）是检查受试外源化学物能否通过妊娠母体引起胚胎毒性或后代畸形的动物试验
A. 雌性生殖毒性试验
B. 急性毒性试验
C. 致突变试验
D. 致畸试验

正确答案：D。致畸试验

解析：本题考查致畸试验。致畸试验（D对ABC错）是检查受试外源化学物能否通过妊娠母体引起胚胎毒性或后代畸形的动物试验。